在水中可膨胀的是
A. 阳离子交换树脂
B. 透析膜
C. 活性炭
D. 硅胶
E. 氧化铝

正确答案：A。阳离子交换树脂

解析：本题考查的是离子交换树脂的结构及性质。在水中可膨胀的是阳离子交换树脂（A对）。阳离子交换树脂为离子色谱法的固定相。离子交换树脂的结构及性质：离子交换树脂外观均为球形颗粒，不溶于水，但可在水中膨胀。透析膜（B错）为一种半透膜，活性炭（C错）、硅胶（D错）与氧化铝（E错）均为固体吸附剂，无法在水中膨胀。